脱汗的特点是
A. 白昼时时汗出，动则益甚
B. 寐中汗出，醒来自止
C. 冷汗如珠，气息微弱
D. 咳而汗出，痰黄质稠
E. 汗出色黄，染衣着色

正确答案：C。冷汗如珠，气息微弱

解析：脱汗时大汗淋漓，汗出如珠，常同时出现声低息微，精神疲惫，四肢厥冷，脉微欲绝或散大无力，多在疾病危重时出现，为病势危急的征象，故脱汗又称为绝汗。其汗出的情况及病情的程度均较自汗、盗汗为重（C对）。白昼时时汗出，动则益甚是自汗的特点（A错）。寐中汗出，醒来自止，是盗汗的特点(B错)。咳而汗出，痰黄质稠，是咳嗽之痰热郁肺证的临床证候之一（D错）。汗出色黄，染衣着色是黄汗的特点（E错）。